有关咀嚼的作用的叙述中，正确的是
A. 咀嚼食物是消化过程的第一步
B. 咀嚼食物对牙齿和牙龈起摩擦和按摩作用
C. 咀嚼时牙齿有轻微的生理性动度
D. 咀嚼能调节进出牙槽骨和牙髓的血液循环
E. 以上均是

正确答案：E。以上均是

解析：咀嚼食物是消化过程的第一步。咀嚼食物对牙齿和牙龈起摩擦和按摩作用。咀嚼时牙齿有轻微的生理性动度，能调节进出牙槽骨和牙髓的血液循环。掌握“牙动度和唇、舌、腭对咀嚼的作用”知识点。